正确描述坐骨神经的是
A. 发自腰丛
B. 大腿内侧群肌由它支配
C. 大腿后群肌由它支配
D. 一般由梨状肌上缘穿出盆腔
E. 在大腿部不发出肌支

正确答案：C。大腿后群肌由它支配

解析：坐骨神经发自骶丛（A错），经梨状肌下孔出盆腔至臀大肌深面（D错），在股后区发出肌支支配股二头肌、半腱肌和半膜肌（C对）。大腿内侧肌群由股神经支配（B错）。